下列四肢动态异常中，因寒邪凝滞所致的临床表现是
A. 四肢痿废
B. 四肢抽搐
C. 手足拘急
D. 手足颤动
E. 手足蠕动

正确答案：C。手足拘急

解析：寒性凝滞、收引，寒邪凝滞四肢筋脉，可致手足筋肉挛急不舒，屈伸不利，即手足拘急（C对）。四肢痿废多因风痰闭阻经络所致（A错）。四肢抽搐多因肝风内动筋脉拘急所致（B错）。手足颤动多因血虚筋脉失养或饮酒过度所致，亦可为动风之兆（D错）。手足蠕动多因脾胃气虚，筋脉失养，或阴虚动风所致（E错）。